下列哪个剂量以下辐照的食品对人体是安全的
A. 1kGy
B. 10kGy
C. 100kGy
D. 1000kGy
E. 1Gy

正确答案：B。10kGy